典型伤寒面容的特点是
A. 面色晦暗，双颊紫红，口唇发绀
B. 表情淡漠，反应迟钝，呈无欲状态
C. 眼裂增大，眼球突出，目光闪烁，呈惊恐貌
D. 面色苍白，颜面浮肿
E. 面色潮红，兴奋不安，口唇干燥

正确答案：B。表情淡漠，反应迟钝，呈无欲状态

解析：表情淡漠，反应迟钝，呈无欲状态是伤寒面容的特点，见于伤寒、脑炎等高热衰弱患者（B对）。面色晦暗，双颊紫红，口唇发绀为二尖瓣面容，见于风湿性心脏病二尖瓣狭窄（A错）。眼裂增大，眼球突出，目光闪烁，呈惊恐貌是甲状腺功能亢进面容，见于甲状腺功能亢进症（C错）。面色苍白，颜面浮肿是肾病面容，见于慢性肾脏病病（D错）。面色潮红，兴奋不安，口唇干燥是急性面容，见于急性发热性疾病如大叶性肺炎、疟疾、流行性脑脊髓膜炎等（E错）。